某男性，在粮库从事粮食烘干工作，工龄25年，近日感觉视物不清，检查证实患有白内障，如与职业有关，则其最可能暴露的射频辐射波段是
A. 超短波
B. 短波
C. 长波
D. 中波
E. 微波

正确答案：E。微波